DIC患者中，血小板，纤维蛋白原含量升高的现象可见于：
A. 代偿型DIC
B. 失代偿型DIC
C. 急性DIC早期
D. 慢性DIC
E. 以上都不是

正确答案：D。慢性DIC

解析：DIC患者中，血小板，纤维蛋白原含量升高的现象可见于慢性DIC （D对ABCE错）。机体代偿功能较好，凝血因子和血小板代偿性生成迅速，甚至超过消耗，可出现纤维蛋白原等暂时性升高，出血或血栓形成症状不明显。常见于慢性DIC或恢复期DIC, 也可转为失代偿型 DIC。